含有大量纤维性药材的处方制丸宜用
A. 嫩蜜，热蜜和药
B. 中蜜，温蜜和药
C. 老蜜，热蜜和药
D. 老蜜，温蜜和药
E. 中蜜，热蜜和药

正确答案：C。老蜜，热蜜和药

解析：本题考查不同类型丸剂的赋形剂。含有大量纤维性药材的处方制丸宜用中蜜，温蜜和药（C对）。影响丸块质量的因素有：①炼蜜程度：蜜过嫩则粉末黏合不好，丸粒搓不光滑；蜜过老则丸块发硬，难以搓丸。②和药蜜温：炼蜜应趁热加入药粉中，粉蜜容易混合均匀。若方中含有大量的叶、茎、全草或矿物性药材，粉末黏性很小，需用老蜜趁热加入；若方中有多量树脂类、胶类、糖及油脂类药味时，药粉黏性较强且遇热易融化。加入热蜜后融化使丸块黏软不易成型，待冷后又变硬，不利制丸，并且服用后丸粒不易溶散，则需用温蜜和药（D错）。蜜温以60℃～80℃为宜。方中含有冰片等芳香挥发性药物，也应用温蜜和药（B错）。③用蜜量：药粉与炼蜜的比例一般是1：1～1：1.5。含糖类、胶质等黏性强的药粉用蜜量宜少；含纤维较多、质地轻松、黏性极差的药粉，用蜜量宜多，可高达1：2以上；夏季用蜜量应少，冬季用蜜量宜多。蜜丸所用蜂蜜需经炼制，其目的在于除去杂质、破坏酶类、杀灭微生物、降低水分含量、增加黏性等。根据炼制程度，炼蜜有嫩蜜、中蜜（炼蜜）、老蜜三种规格，适合于不同性质的药粉制丸。①嫩蜜（A错）：炼制温度在105℃～115℃，含水量为17%～20%，相对密度约为1.35，色泽无明显变化，稍有黏性。适合于含较多黏液质、胶质、糖、淀粉、油脂、动物组织等黏性较强的药粉制丸。②中蜜（又称炼蜜）：炼制温度达116℃～118℃，含水量在14%～16%，相对密度为1.37左右，炼制时表面翻腾“鱼眼泡”（黄色均匀而有光泽的气泡）。手指捻有黏性，但两指分开时，指间无长白丝出现。适用于黏性中等的药粉制丸，为大部分蜜丸所采用。③老蜜：炼制温度达119℃～122℃，含水量在10%以下，相对密度约为1.40，呈红棕色。炼制时表面出现“牛眼泡”（较大的红棕色气泡），能“滴水成珠”（滴入冷水呈球形而不散）。手指捻黏性强，两指分开时，有白色长丝（俗称“打白丝”）。适用于黏性差的矿物药或富含纤维的药粉制丸。